患者，男，2日来发热微恶寒，口苦，胁痛，尿短黄，大便粘臭，舌红苔薄白，脉数。其证候是
A. 表里俱热
B. 表寒里热
C. 真寒假热
D. 真热假寒
E. 表热里寒

正确答案：B。表寒里热

解析：患者2日来发热微恶寒为外感风寒；患者尿短黄，大便粘臭为里有热；故为表寒里热（B对）。患者2日来发热微恶寒为外感风寒，非表里俱热（A错）。真热假寒指内有真热而外见某些假寒的“热极似寒”证候，但这些“寒象”与真正寒证的表现有所不同，如四肢虽厥冷而胸腹部必灼热；而患者外感风寒是真的寒象（D错）。真寒假热指内有真寒而外见某些假热的“寒极似热”证候，而患者有尿短黄，大便粘臭的里热证（C错）。表热里寒也是寒热错杂的一种表现。多见于素有里寒而复感风热；或表热未解，误下以致脾胃阳气损伤的病证（E错）。